下列哪对小脑脚的传入纤维包括脊髓小脑前束
A. 小脑上脚
B. 小脑中脚
C. 小脑下脚
D. 小脑中、下脚
E. 以上均不对

正确答案：A。小脑上脚

解析：和小脑有关的传入、传出纤维组成了小脑上、中、下三对脚。小脑上脚（A对）的传入纤维包括脊髓小脑前束、三叉小脑束、起自顶盖和红核的顶盖小脑束和红核小脑束；小脑中脚（BD错）的传入纤维几乎全部由对侧脑桥核发出的脑桥小脑纤维构成；小脑下脚（CD错）的传入纤维包括起于前庭神经、前庭神经核、延髓下橄榄核、延髓网状结构进入小脑的纤维、脊髓小脑后束及楔小脑束的纤维。